实验流行病学研究中将研究对象随机分配到实验组和对照组的目的是
A. 提高实验的敏感性
B. 增加研究对象的依从性
C. 使实验组和对照组都受益
D. 使研究对象更具有代表性
E. 提高两组的可比性

正确答案：E。提高两组的可比性

解析：本题考查实验流行病学随机化分组的目的。在实验流行病学研究中，随机化分组是将研究对象随机分配到实验组和对照组，使每个研究对象都有同等的机会被分配到各组去，以平衡实验组和对照组各种已知和未知的混杂因素，从而提高两组的可比性（E对ABCD错），避免造成偏倚。